下列哪项不是涩脉的主病
A. 血少
B. 气滞
C. 精伤
D. 血瘀
E. 湿阻

正确答案：E。湿阻

解析：涩脉的脉象特点是形细而行迟，往来艰涩不畅，脉势不匀，多见于气滞、血瘀、痰食内停和精伤、血少。气滞（B对）、血瘀（D对）、痰浊、宿食等邪气内停，阻滞脉道，气机不畅，血行瘀滞，以致脉气往来艰涩，此系实邪内盛，正气未衰，故脉涩而有力；精伤（C对）血少（A对），津液耗伤，不能充养脉道，久而脉失濡润，气血运行不畅，以致脉气往来艰涩而无力。湿困脾胃，郁遏阳气，阻压脉道，可出现濡脉（E错，为本题正确答案）。